我国总结出的防尘“八字”经验是
A. 革、水、防、风、护、治、教、查
B. 革、水、密、风、护、管、教、查
C. 革、水、密、保、护、管、教、查
D. 革、水、密、风、护、管、封、查
E. 革、水、密、保、护、管、封、查

正确答案：B。革、水、密、风、护、管、教、查

解析：本题考查防治粉尘的八字方针。八字方针，即革、水、密、风、护、管、教、查（B对ACDE错）。1.革，要求改革生产工艺和革新生产设备，是消除粉尘危害的根本途径；2.水，即湿式作业，增大空气湿度，可降低环境粉尘浓度；3.密，密闭尘源；4.风，加强通风及抽风除尘；5.护，做好个人防护；6.管，经常性地维修和管理工作；7.教，加强宣传教育；8.查，定期检查环境空气中粉尘浓度，保证接触者的定期体格检查。